对绿脓杆菌有较强作用的药物是
A. 氯唑西林
B. 美西林
C. 阿莫西林
D. 哌拉西林
E. 替莫西林

正确答案：D。哌拉西林

解析：本题考查哌拉西林。哌拉西林（D对）为抗铜绿假单胞菌广谱青霉素，对G⁻杆菌包括铜绿假单胞菌（绿脓杆菌）有很强抗菌作用。氯唑西林（A错）主要用于产酶金黄色葡萄球菌或其它葡萄球菌所致的败血症、肺炎。美西林（B错）用于大肠杆菌、克雷白菌属、肠杆菌属等敏感微生物引起的单纯性或复合性泌尿道感染。替莫西林（E错）对革兰阴性杆菌有高度的抗菌活性，对G⁺作用弱。阿莫西林（C错）主要用于敏感菌所致的呼吸道、尿路、胆道感染以及伤寒治疗。